以下哪项不是根管充填剂应具备的性能
A. 根充后有持续的消毒作用
B. 充填后有一定的体积收缩
C. 能促进根尖周病变的愈合
D. 能与根管壁密合
E. X线阻射

正确答案：B。充填后有一定的体积收缩

解析：根管充填的目的是封闭根管系统，防止细菌进入根管系统造成根管的再感染和组织液进入根管成为残余细菌的培养基，如果根充材料收缩可能会出现上述情况。根管充填材料的性能要求如下：①根管充填后有持续的消毒作用；②与根管壁能密合；③能促进根尖周病变的愈合④根管充填后不收缩；⑤易于消毒、使用和去除；⑥不使牙变色；⑦对机体无害；⑧x线阻射便于检查。掌握“根管充填”知识点。